某妇女下腹部疼痛，阴道有大量黄色、无血、无气味的分泌物，1周前曾做过经阴道结扎术。检查时，从阴道后穹隆穿刺，得20ml带血、恶臭的脓性物，厌氧培养出革兰阴性杆菌。请问该化脓感染的病原体可能是下列哪项
A. 大肠埃希菌
B. 铜绿假单胞菌
C. 变形杆菌
D. 脆弱类杆菌
E. 肉毒梭菌

正确答案：D。脆弱类杆菌